女，77岁。反复咳嗽咳痰30年，近5年来长期夜间家庭氧疗。1周前因受凉后出现喘息，夜间入睡困难。昨夜自服“舒乐安定（艾司唑仑）”2片，并将吸氧流量提高至4L/min，自觉喘息症状有所改善。今晨家属发现其呼之不应。入院查体：轻度昏迷，球结膜水肿，口唇无发绀。双肺呼吸音低。双侧Babinski征（±）。该患者最可能出现的问题是
A. 电解质紊乱
B. 氧中毒
C. 肺性脑病
D. 镇静剂中毒
E. 脑梗死

正确答案：C。肺性脑病

解析：77岁老年女性患者，反复咳嗽咳痰30年，考虑有COPD，患者因感染导致呼吸困难急性加重，增加氧流量反而使患者外周化学感受器被抑制，出现呼吸抑制，CO₂潴留从而出现肺性脑病（C对）。电解质紊乱（A错）不会出现球结膜水肿等症状。氧中毒（B错）常见症状为咳嗽、呼吸困难、面部肌肉抽搐、出汗、流涎、恶心、呕吐、眩晕、心悸和面色苍白等。舒乐安定（D错）（规格为1mg）成人常催眠用量：1~2mg，睡前服，该患者服用2片不至于导致镇静剂中毒。脑梗死（E错）常合并有动脉硬化、高血压、高脂血症或糖尿病等危险因素或对应的全身性非特异性症状，慢性支气管炎一般不考虑并发脑梗死。